在DNA重组实验中使用DNA连接酶的目的是
A. 催化质粒与噬菌体的连接
B. 获得较小的DNA片段
C. 扩展待定DNA序列
D. 使DNA与载体结合
E. 鉴定重组DNA片段

正确答案：D。使DNA与载体结合